下列哪一种传染病一般呈严格的季节性
A. 虫媒传染病
B. 寄生虫病
C. 呼吸道传染病
D. 肠道传染病
E. 血液传染病

正确答案：A。虫媒传染病

解析：本题考查严格的季节性概念。严格的季节性是指在某些地区以虫媒传播（A对BCDE错）的传染病发生有严格的季节性，发病多集中在少数几个月内，其余月份没有病例的发生。